下列哪项不是生活饮用水水质卫生规范制定的依据
A. 毒理学指标
B. 感官性状指标和一般化学指标
C. 细菌学指标
D. 放射性指标
E. 流行病学指标

正确答案：E。流行病学指标

解析：本题考查生活饮用水水质卫生规范制定的依据。生活饮用水水质卫生规范制定的依据有：微生物学指标（C对）、毒理学指标（A对）、感官性状和一般化学指标（B对）、放射性指标（D对）及消毒剂指标。流行病学指标（E错，为本题正确答案）不是生活饮用水水质卫生规范制定的依据。